女，48岁。外阴瘙痒伴灼热感3天。妇科检查见外阴红肿、小阴唇内侧及阴道黏膜表面有白色凝乳状物覆盖。该患者首先考虑为
A. 前庭大腺炎
B. 淋菌性阴道炎
C. 外阴阴道假丝酵母菌病
D. 滴虫性阴道炎
E. 细菌性阴道炎

正确答案：C。外阴阴道假丝酵母菌病

解析：患者女，48岁，外阴瘙痒伴灼热感3天（外阴瘙痒、灼痛为外阴阴道假丝酵母菌病典型表现，灼热感即灼痛，此处还有性交痛、尿痛）。妇科检查见外阴红肿、小阴唇内侧及阴道黏膜表面有白色凝乳状物（典型表现，也可呈豆腐渣样）覆盖，根据患者症状、体征，诊断考虑外阴阴道假丝酵母菌病（C对）。外阴阴道假丝酵母菌病（VVC）曾称外阴阴道念珠菌病，是由假丝酵母菌引起的常见外阴阴道炎症。前庭大腺炎（P246）（A错）炎症多为一侧，初起时局部肿胀、疼痛、灼热感，行走不便，有时会致大小便困难，检查见局部皮肤红肿、发热、压痛明显，患侧前庭大腺开口处有时可见白色小点。淋菌性阴道炎（B错）主要表现为外阴瘙痒、灼痛感，粘膜充血、水肿，触痛，白带量多呈脓性。滴虫阴道炎（P247）（D错）是由阴道毛滴虫引起的阴道炎症，主要症状是阴道分泌物增多及外阴瘙痒，分泌物典型特点为稀薄脓性、黄绿色、泡沫状、有臭味。细菌性阴道炎（P251）（E错）有症状患者主要表现为阴道分泌物增多，有鱼腥臭味，检查见阴道粘膜无充血的炎症表现，分泌物特点为灰白色，均匀一致，稀薄，易从阴道壁拭去。